在复方乙酰水杨酸片中，可作为黏合剂的辅料是
A. 轻质液体石蜡
B. 淀粉浆（15%～17%）
C. 滑石粉
D. 干淀粉
E. 酒石酸

正确答案：B。淀粉浆（15%～17%）

解析：本题考查复方乙酰水杨酸片的处方分析。乙酰水杨酸的可压性极差，因而采用了较高浓度的淀粉浆（B对）（15%～17%）作为黏合剂。淀粉的剩余部分（干淀粉）（D错）作为崩解剂而加入，但要注意混合均匀。滑石粉（C错）作为润滑剂。酒石酸（E错）作为稳定剂。